男，14岁，半年前因“上感”自服青霉素后症状消失，近2天发生少尿、双下肢水肿。实验室检查：血Cr185umol/L，尿蛋白（++），红细胞25～30/HP，该病的致病因素为
A. 遗传因素
B. 药物
C. 病毒感染
D. 链球菌感染
E. 免疫因素

正确答案：E。免疫因素

解析：患者14岁，曾有“上感”史，半年前服用青霉素后症状消失（前驱感染），近两天发生少尿、双下肢水肿，实验室检查：血Cr185umol/L，尿蛋白（++），红细胞25～30/HP（少尿、水肿、血肌酐升高、蛋白尿和血尿均为急性肾小球肾炎的典型表现），综上可考虑诊断为因免疫复合物沉积引起的急性肾小球肾炎，该病的致病因素为免疫因素（E对）。